下列关于盆膈的说法何者正确
A. 由会阴深横肌及盆膈上、下筋膜构成
B. 由肛提肌及盆膈上、下筋膜构成
C. 由肛提肌、尾骨肌及盆膈上、下筋膜构成
D. 由肛提肌及尿生殖膈构成
E. 由肛提肌、尾骨肌及盆膈下筋膜构成

正确答案：C。由肛提肌、尾骨肌及盆膈上、下筋膜构成

解析：盆膈由肛提肌、尾骨肌及盆膈上、下筋膜构成(C对)。